奋乃静含量测定所用的溶剂为
A. 丙酮
B. 乙醚
C. 冰醋酸
D. N，N-二甲基甲酰胺
E. 甲醇

正确答案：C。冰醋酸